关于蛋白多肽类药物的说法，正确的是
A. 口服吸收好
B. 副作用少
C. 稳定性好
D. 作用时间长
E. 药理活性低

正确答案：B。副作用少

解析：本题考查蛋白多肽类药物特点。蛋白多肽类药物的特点有：①基本原料简单易得；②药效高，副作用低（B对），不蓄积中毒；③用途广泛，品种繁多，新型药物层出不穷；④研发过程目标明确，针对性强。